治疗慢惊风阴虚风动证，应首选
A. 大定风珠
B. 十全大补汤
C. 缓肝理脾汤
D. 固真汤
E. 逐寒荡惊汤

正确答案：A。大定风珠

解析：慢惊风阴虚风动证治宜育阴潜阳，滋肾养肝，方选大定风珠（A对）。十全大补汤功能温补气血，主治气血两虚证（B错）。缓肝理脾汤功能温中健脾，缓肝理脾，为慢惊风脾虚肝亢的选方（C错）。固真汤与逐寒荡惊汤两方相合功能温补脾肾，回阳救逆，治疗慢惊风脾肾阳虚证（DE错）。